队列研究属于
A. 描述性研究
B. 分析性研究
C. 实验性研究
D. 理论与方法学研究
E. 统计分析法

正确答案：B。分析性研究

解析：本题考查队列研究的概念。队列研究属于分析流行病学（B对ACDE错）研究，它是通过直接观察某因素不同暴露状况人群的结局来探讨该因素与所观察结局的关系。